急性放射病是指
A. 短期内一次受到大剂量照射所引起的全身性改变
B. 短期内多次受到大剂量照射所引起的全身性改变
C. 短期内一次或多次受到大剂量照射所引起的全身性改变
D. 一周内多次受到大剂量照射所引起的全身性改变
E. 一月内多次受到大剂量照射所引起的全身性改变

正确答案：C。短期内一次或多次受到大剂量照射所引起的全身性改变